苯丙酮尿症早治疗的主要目的是
A. 减少皮肤湿疹
B. 防止智力发育落后
C. 使头发及皮肤颜色转为正常
D. 控制惊厥
E. 减少尿臭味

正确答案：B。防止智力发育落后

解析：苯丙酮尿症的临床表现中智力发育落后最为突出，智商常低于正常。早治疗的主要目的是防止智力发育落后（B对）。